下述哪个结构不属于眼球的屈光系统
A. 角膜
B. 房水
C. 虹膜
D. 晶状体
E. 玻璃体

正确答案：C。虹膜

解析：眼球的屈光系统包括角膜（A对）、房水（B对）、晶状体（D对）和玻璃体（E对），虹膜（C错，为本题正确答案）不属于眼球的屈光系统。